巴戟天原植物所属的科是
A. 玄参科
B. 唇形科
C. 伞形科
D. 天南星科
E. 茜草科

正确答案：E。茜草科

解析：本题考查的是中药的来源。巴戟天原植物所属的科是茜草科（E对）。巴戟天：【来源】为茜草科植物巴戟天的干燥根。来源于玄参科（A错）的中药有玄参、地黄、胡黄连等。来源于唇形科（B错）的中药有丹参、黄芩、紫苏叶、广藿香、荆芥、益母草、薄荷、半枝莲、香薷等。来源于伞形科（C错）的中药有当归、川芎、柴胡、白芷、羌活等。来源于天南星科（D错）的中药有天南星、半夏、石菖蒲等。